根据经脉分布，以确定病位所在，两侧头痛，所属的是
A. 少阴头痛
B. 太阳头痛
C. 厥阴头痛
D. 少阳头痛
E. 阳明头痛

正确答案：D。少阳头痛

解析：本题考查的是不同部位疼痛的临床意义。根据经脉分布，以确定病位所在，两侧头痛，所属的是少阳头痛（D对）。头痛的临床意义：头为诸阳之会，脑为髓之海，十二经脉与奇经八脉大都与头部有联系，尤其是三阳经，直接循行于头部。某些外感邪气，如风、寒、暑、湿、火以及痰浊、瘀血阻滞或上扰清阳，所引起的头痛多为实证。气血津液亏损，不能上荣于头，致使脑海空虚，也可以发生头痛，则属于虚证。凡头痛之在于经脉者，可根据经络的分布，以确定其病位之所在。如头项痛属太阳经（B错），前额痛属阳明经（E错），头侧痛属少阳经，头顶痛属厥阴经（C错）等。有时头疼常常伴有头晕，需要参考头晕的辨证特点。